厥阴头痛的部位在
A. 头后部
B. 前额部
C. 眉棱骨
D. 巅顶部
E. 头之两侧

正确答案：D。巅顶部

解析：头为诸阳之会，手足三阳经均循头面，厥阴经亦上会于巅顶，由于受邪之脏腑经络不同，头痛之部位亦不同。大抵太阳头痛，在头后部，下连于项（A错）；阳明头痛，在前额部及眉棱骨等处（BC错）；少阳头痛，在头之两侧，并连及于耳（E错）；厥阴头痛则在巅顶部位，或连目系（D对）。